骨骼疾病，如骨损伤、变形性骨炎。骨折恢复期、佝偻病、骨软化症等，可出现活性升高的酶是
A. ALP
B. ALT
C. AST
D. AMS
E. γ-GT

正确答案：A。ALP

解析：本题考查的是血清碱性磷酸酶（ALP）的临床意义。骨骼疾病，如骨损伤、变形性骨炎。骨折恢复期、佝偻病、骨软化症等，可出现活性升高的酶是ALP（A对）。血清碱性磷酸酶（ALP）：ALP为一组单酯酶，广泛存在于人体组织和体液中，其中以骨、肝、乳腺、小肠、肾脏的浓度较高。碱性磷酸酶可催化磷酸酯的水解反应，并有转移磷酸基的作用。当上述器官病变时，此酶的活性增强。血清丙氨酸氨基转移酶（ALT（B错））：ALT是一组催化氨基酸与α-酮酸间氨基转移反应的酶类，主要存在于肝、肾、心肌、骨骼肌、胰腺、脾、肺、红细胞等组织细胞中，同时也存在于正常体液如血浆、胆汁、脑脊液、唾液中。当富含ALT的组织细胞受损时，ALT从细胞释放增加，进入血液后导致ALT活力上升。其增高的程度与肝细胞被破坏的程度呈正比。血清天门冬氨酸氨基转移酶（AST（C错））：AST同样是体内最重要的氨基转移酶之一，催化L-天门冬酸与α-酮戊二酸间氨基转移反应，旧称谷丙转氨酶（GPT）。AST同样主要存在于心肌、肝肾、骨骼肌、胰腺、脾、肺、红细胞等组织细胞中；同时也存在于正常人血浆、胆汁、脑脊液及唾液中。当富含AST的组织细胞受损时，细胞通透性增加，AST从细胞释放增加，进入血液后导致AST活力上升。AMS（D错）为淀粉酶。淀粉酶（AMY）：AMY主要来自胰腺和腮腺。来自胰腺的为淀粉酶同工酶P（P-AMY），来自腮腺的为淀粉酶同工酶S（S-AMY），其他少量的AMY来自心脏、肝脏等。AMY主要用于急性胰腺炎的诊断和鉴别诊断，活性增高或降低均有临床意义。γ-GT（E错）为血清γ-谷氨酰转移酶。血清γ-谷氨酰转移酶（GGT）：GGT是将肽或其他化合物的γ-谷氨酰基转移至某些γ-谷氨酰受体上的酶。GGT主要存在于血清及除肌肉外的所有组织中，如在肾、胰、肝、大肠、心肌组织中，其中以肾脏最高，但血清中的GGT主要来自肝胆系统。